当正中（牙合）有早接触，非正中（牙合）协调时，应磨改
A. 上颌磨牙颊尖的（牙合）斜面
B. 下颌磨牙舌尖的（牙合）斜面
C. 舌窝或（牙合）窝的早接触区
D. 早接触的牙尖
E. 早接触的下前牙切缘

正确答案：C。舌窝或（牙合）窝的早接触区

解析：本题考查选磨原则。选磨法是指用砂石轮等磨改牙齿外形以消除创伤（牙合）的方法。选磨以消除早接触点为主，当正中（牙合）有早接触，非正中（牙合）协调时，说明仅有个别牙尖与舌窝或（牙合）窝在正中（牙合）时比其他牙齿先接触，而当牙尖循斜面滑行时，则咬合协调无早接触故此时不可磨改牙尖，只能磨改其相对应的舌窝或（牙合）窝的早接触区（C对）。上颌磨牙颊尖的（牙合）斜面（A错）和下颌磨牙舌尖的（牙合）斜面（B错）是当正中（牙合）协调，非正中（牙合）不协调时进行磨改。早接触的牙尖（D错）和早接触的下前牙切缘（E错）是当正中（牙合）和非正中（牙合）都存在早接触或不协调时进行磨改。